对盐酸可乐定阐述不正确的是
A. α₂受体激动剂
B. 抗高血压药物
C. 分子结构中含2，6-二氯苯基
D. 分子结构中含噻唑环
E. 分子有两种互变异构体

正确答案：D。分子结构中含噻唑环